下列各项，不属猩红热的特殊体征是
A. 杨梅舌
B. 咽峡炎
C. 舌系带溃疡
D. 环口苍白圈
E. 帕氏线

正确答案：C。舌系带溃疡

解析：猩红热的特殊体征是：杨梅舌、咽峡炎（B对）、环口苍白圈（D对）、帕氏线。病初舌苔白，红肿乳头可突出于白苔之外。以后白苔脱落，露出鲜红舌面，舌乳头红肿明显并持续存在，形成"杨梅"样舌（A对）。咽及扁桃体显著充血，扁桃体陷窝处覆有较易拭掉的点状或片状白色脓性分泌物，软腭处有细小红疹或出血点。面颊部潮红无皮疹，而口鼻周围皮肤苍白，形成"口周苍白圈"。在皮肤皱褶的腋窝、肘弯、腹股沟等处，皮疹色深红，可密集成深红色横纹线状，称之为"帕氏线"（E对）（C错，为本题正确答案）。